患儿，9岁。发热一天，突发抽搐，神志不清，面色苍白，呼吸促而弱，皮肤干燥，尿少口干，四肢厥冷，唇舌干绛，苔少而干，脉细数而无力，诊断为感染性休克。其首选方剂是
A. 人参养荣丸加减
B. 参附汤加减
C. 生脉饮加减
D. 小承气汤加减
E. 清瘟败毒散加减

正确答案：C。生脉饮加减

解析：气阴亏竭证是由于阴虚日久，阴不化气而气失化源，或因邪热疫毒伤损，伤阴耗气，导致机体气阴不足，功能减退所表现的证候（C对）。人参养荣丸具有温补气血功效。用于心脾不足，气血两亏，形瘦神疲，食少便溏，病后虚弱（A错）。阴竭阳脱证症状：神志不清，面色青灰，皮肤紫花或大片瘀斑，体温不升，皮肤湿冷，四肢冰凉过肘膝，汗出如油，呼吸不整，唇紫发青，苔白滑，脉微欲绝，或指纹淡隐。治法：益气回阳，救逆固脱。方药：参附汤或参附龙牡救逆汤加减（B错）。感染性休克热毒内闭证症状：高热，烦躁，或精神萎靡，甚则神志昏迷，强直抽搐，喉中痰鸣，胸腹灼热，口渴喜饮，面色苍白，手足厥冷，小便短赤，大便秘结，舌红，苔黄燥，脉数，宜清热解毒，通腑开窍。清瘟败毒饮合小承气汤加减（DE错）。